微波对血液系统的影响是
A. 白血病
B. 贫血
C. 血小板减少
D. 外周血白细胞总数减少
E. 再生障碍性贫血

正确答案：D。外周血白细胞总数减少